μ受体的激动药是
A. 吲哚美辛
B. 塞来昔布
C. 哌替啶
D. 纳洛酮
E. 喷它佐辛

正确答案：C。哌替啶

解析：本题考查μ受体的激动药。哌替啶（C对）属于阿片类受体完全激动剂，主要激动μ受体；纳洛酮（D错）属于阿片类受体拮抗药；喷他佐辛（E错）属于阿片受体部分激动剂；吲哚美辛（A错）、塞来昔布（B错）属于芳酸类非甾体抗炎药。